不属于牙种植术适应证的是
A. 磨牙缺失或游离端缺牙的修复
B. 活动义齿固位差、无功能、黏膜不能耐受者
C. 肿瘤或外伤所致单侧或双侧颌骨缺损，需功能性修复者
D. 某些骨疾病，如骨质疏松症、骨软化症及骨硬化症等
E. 上下颌部分或个别缺牙，邻牙不宜作基牙或避免邻牙受损者

正确答案：D。某些骨疾病，如骨质疏松症、骨软化症及骨硬化症等

解析：骨质疏松症、骨软化症及骨硬化症者属于禁忌症。掌握“牙种植手术及效果评估”知识点。